治肾不化气，清浊不分所致的白浊，宜选
A. 三金片
B. 五苓散
C. 肾炎四味片
D. 茵陈五苓丸
E. 萆薢分清丸

正确答案：E。萆薢分清丸

解析：本题考查的是萆薢分清丸的主治。治肾不化气，清浊不分所致的白浊，宜选萆薢分清丸（E对）。萆薢分清丸：【主治】肾不化气、清浊不分所致的白浊、小便频数。三金片（A错）：【主治】下焦湿热所致的热淋，症见小便短赤、淋沥涩痛、尿急频数；急性肾盂肾炎、慢性肾盂肾炎、膀胱炎、尿路感染见上述证候者；慢性非细菌性前列腺炎肾虚湿热下注证。五苓散（B错）：【主治】阳不化气、水湿内停所致的水肿，症见小便不利、水肿腹胀、呕逆泄泻、渴不思饮。肾炎四味片（C错）：【主治】湿热内蕴兼气虚所致的水肿，症见浮肿、腰痛、乏力、小便不利；慢性肾炎见上述证候者。茵陈五苓丸（D错）：【主治】肝胆湿热、脾肺郁结所致的黄疸，症见身目发黄、脘腹胀满、小便不利。